下列有关流行性出血热少尿期的叙述，错误的是
A. 可直接由发热期进入少尿期
B. 可与低血压休克期重叠
C. 可与发热期重叠
D. 主要是由低血压引起的
E. 重者可出现高血容量综合征

正确答案：D。主要是由低血压引起的

解析：少尿期主要是由缺血性肾小管坏死和肾小球滤过率下降引起的（D错，为本题正确答案）。流行性出血热少尿期一般发生于第5～8病日，持续时间短者1日，长者可达十余日，一般2～5日。可与休克期重叠（B对），或由发热期直接进入少尿期（A对）。此期主要表现为少尿或无尿，可引起尿毒症、酸中毒、水和电解质紊乱、高血容量综合征（E对）和肺水肿等。